为优良广谱消毒剂，无色、无刺激，腐蚀性较小。有机物对其消毒效果影响极微。适用于多种医疗器械的消毒。此种试剂是
A. 乙醇
B. 碘伏
C. 甲醛
D. 含氯消毒剂
E. 戊二醛

正确答案：E。戊二醛

解析：戊二醛：此为一优良广谱消毒剂，能杀灭各种细菌繁殖体、芽孢以及真菌与病毒。无色、无刺激，腐蚀性较小。有机物对其消毒效果影响极微。适用于多种医疗器械的消毒。掌握“口外消毒和灭菌”知识点。